每克蛋白质在体内可产生多少热能
A. 9kcal
B. 4kcal
C. 5kcal
D. 15kcal
E. 6kcal

正确答案：B。4kcal